中药茵陈依采收期不同可分为“绵茵陈”和“花茵陈”，二者采收时间分别为
A. 春季，冬季
B. 春季，夏季
C. 春季，秋季
D. 夏季，秋季
E. 夏季，冬季

正确答案：C。春季，秋季

解析：本题考查的是中药的采收时间。中药茵陈依采收期不同可分为“绵茵陈”和“花茵陈”，二者采收时间分别为春季，秋季（C对）。全草类中药的采收时间：多在植物充分生长，茎叶茂盛时采割，如青蒿、穿心莲、淡竹叶等；有的则在花期采收，如薄荷、益母草、荆芥、香薷等。全草类中药采收时大多割取地上部分，少数连根挖取全株药用，如金钱草、蒲公英等。茵陈有两个采收时间，春季幼苗高6～10cm时或秋季花蕾长成时。春季采的习称“绵茵陈”，秋季采的习称“花茵陈”。